某男，62岁。患白浊、小便频数，医师处以萆薢分清丸。此成药处方的组成除粉萆薢、盐益智仁外，还有
A. 车前子、滑石、乌药
B. 车前子、乌药、甘草
C. 石菖蒲、滑石、甘草
D. 金钱草、沉香、土茯苓
E. 乌药、石菖蒲、甘草

正确答案：E。乌药、石菖蒲、甘草

解析：本题考查的是萆薢分清丸的药物组成。某男，62岁。患白浊、小便频数，医师处以萆薢分清丸。此成药处方的组成除粉萆薢、盐益智仁外，还有乌药、石菖蒲、甘草（E对）。萆薢分清丸：【药物组成】粉萆薢、益智仁（盐炒）、乌药、石菖蒲、甘草。